非霍奇金淋巴瘤首选的治疗方法
A. 以手术为主的综合序列治法
B. 放射为主，化疗为辅
C. 以环磷酰胺为主的化学疗法
D. 姑息疗法
E. 冷冻治疗

正确答案：C。以环磷酰胺为主的化学疗法

解析：本题考查非霍奇性淋巴瘤的治疗方法。非霍奇性淋巴瘤首选的治疗方法是以环磷酰胺为主的化学疗法（C对）。恶性淋巴瘤系起源于淋巴系统的恶性肿瘤。在病理上可分为霍奇金淋巴瘤（HL）与非霍奇金淋巴瘤（NHL）两大类。非霍奇金淋巴瘤主要以化疗为主的综合疗法进行干预。